感冒的治疗，可分别采用辛温解表或辛凉解表，此属于
A. 辨病论治
B. 因人制宜
C. 同病异治
D. 异病同治
E. 辨证论治

正确答案：C。同病异治

解析：感受风寒之邪所致风寒束表之感冒，可采用辛温解表；感受风热之邪所致风热犯表之感冒，可采用辛凉解表；同一种病采用不同的治法，即同病异治（C对）。“辨病论治”是以病作为辨析目标，治疗也就依据病来施行（A错）。“因人制宜”是根据病人的年龄、性别、体质等不同特点，来制订适宜的治疗原则（B错）。 “异病同治”指几种不同的疾病，在其发展变化过程中出现了大致相同的病机，大致相同的证，故可用大致相同的治法和方药来治疗”（D错）。“辨证论治”是运用中医学理论辨析有关疾病的资料以确立证候，论证其治则治法方药并付诸实施的思维和实践过程（E错）。